正确描述迷走神经的是
A. 发出左喉返神经绕行左锁骨下动脉
B. 发出窦神经分布颈动脉窦与颈动脉小球
C. 越过肺根前方
D. 穿过膈肌主动脉裂孔入腹腔
E. 颈部行于颈总动脉与颈内静脉之间的后方

正确答案：E。颈部行于颈总动脉与颈内静脉之间的后方

解析：迷走神经出颅后在颈部行于颈总动脉与颈内静脉之间的后方（E对），下行经胸廓上口进入胸腔。在胸腔中，左迷走神经在左颈总动脉与左锁骨下动脉之间下行，越过主动脉弓前方，经左肺根后方（C错）至食管前面下行并分成许多细支，构成左肺丛和食管前丛，于食管下段延续为迷走神经前干。右迷走神经经右锁骨下动、静脉之间下行，沿气管右侧，经右肺根后方（C错）达食管后面，分支构成右肺丛和食管后丛，继续下行又集中构成迷走神经后干。迷走神经前、后干与食管一同穿膈肌的食管裂孔（D错）进入腹腔，在腹腔中分成许多小支分布于自胃至横结肠的消化管及肝、胰、脾、肾等实质性脏器。迷走神经在胸部主动脉弓前方发出左喉返神经，而后绕行主动脉弓（A错）返回至顶部。分布于颈动脉窦与颈动脉小球（B错）的神经为舌咽神经颈动脉窦支。